可作为润滑剂的是
A. 羧甲基淀粉钠
B. 硬脂酸镁
C. 乳糖
D. 羟丙基甲基纤维素溶液
E. 水

正确答案：B。硬脂酸镁

解析：本题考查片剂的常用辅料。广义的润滑剂按作用不同可以分为三类：助流剂、抗黏剂和狭义润滑剂。常用的润滑剂（广义）有硬脂酸镁（MS）（B对）、微粉硅胶、滑石粉、氢化植物油、聚乙二醇类、十二烷基硫酸钠等。羧甲基淀粉钠（A错）为崩解剂。乳糖（C错）为填充剂。羟丙基甲基纤维素（D错）为黏合剂。蒸馏水（E错）为润湿剂。